患者31岁。12月末发病，头痛、发热、恶心、呕吐，腰痛4天，查体：面色潮红，结膜充血，腋下可见点状出血，化验：白细胞15×10⁹/L，中性粒细胞72%，淋巴细胞20%，异淋8%，尿蛋白（+++），己确诊为肾综合征出血热。下列选项中哪项是肾综合征出血热特征性改变
A. 病程长短
B. 热退后症状加重
C. 血尿的情况
D. 贫血程度
E. 颅内压力

正确答案：B。热退后症状加重

解析：多数肾综合征出血热患者在发热末期或者热退同时出现血压下降，少数在热退后发生。当血容量持续下降则出现面色苍白，四肢厥冷，脉搏细速不能触及，尿量减少等。当大脑供血不足时，可出现烦躁、谵妄、神情恍惚等。少数顽固性休克患者因长期组织灌注不良、还会出现发绀，进而引发DIC、ARDS和急性肾衰等，即热退后症状加重（B对）。因病情严重程度及病人身体素质不同，病程长短（A错）、血尿（C错）、贫血（D错）及颅内压力（E错）的情况均可有所不同，并非为特征性改变。